急性低钾血症对心肌生理特性的影响是
A. 兴奋性下降，传导性下降，自律性升高，收缩性升高
B. 兴奋性升高，传导性降低，自律性升高，收缩性升高
C. 兴奋性升高，传导性升高，自律性升高，收缩性升高
D. 兴奋性升高，传导性升高，自律性下降，收缩性升高
E. 兴奋性下降，传导性下降，自律性下降，收缩性下降

正确答案：B。兴奋性升高，传导性降低，自律性升高，收缩性升高

解析：低钾血症时由于细胞外液钾浓度降低，心肌细胞膜对K⁺的通透性下降，静息电位(Em)负值减小，与阈电位(Et)之间的距离(Em-Et)减小，细胞兴奋性升高（AE错）。心肌细胞膜对K⁺的通透性下降，复极化4期K⁺外流减慢，而Na⁺内流相对加速，心肌自律性增高（D错）。心肌细胞膜Em绝对值减少，去极化时Na⁺内流速度减慢，故动作电位0期去极化速度减慢和幅度降低，兴奋的扩布因而减慢，心肌传导性降低（C错）。轻度低钾血症时，其对Ca2⁺内流的抑制作用减弱，因而复极化2期时Ca2⁺内流增多，心肌收缩性增强（B对）。